急性脑病综合症最多见的幻觉
A. 视幻觉
B. 听幻觉
C. 嗅幻觉
D. 味幻觉
E. 触幻觉

正确答案：A。视幻觉

解析：急性脑病综合症（谵妄综合症）的临床特征包括：1.意识障碍：为主要特征，有明显的昼夜节律变化，表现为昼轻夜重；2.感知障碍：错觉和幻觉，以视错觉和视幻觉（A对）最常见；3.注意障碍：注意涣散，表现为注意力不集中；4.定向障碍：对周围环境与事物的觉察清晰度降低。常考，请牢记。